地西泮中毒的解救药物是
A. 阿托品+碘解磷定
B. 氟马西尼
C. 硫代硫酸钠
D. 乙酰半胱氨酸
E. 纳洛酮

正确答案：B。氟马西尼

解析：本题考查中毒解救。地西泮中毒的解救药物是氟马西尼（B对）。地西泮属于苯二氮䓬类药物，氟马西尼是特异的苯二氮䓬受体拮抗剂，能快速逆转昏迷，首次静脉注射剂量为0.3mg。阿托品+碘解磷定（A错）可用于有机磷中毒解救。硫代硫酸钠（C错）主要用于氰化物中毒，也用于砷、汞、铅中毒等。乙酰半胱氨酸（D错）用于对乙酰氨基酚过量所致的中毒。纳洛酮（E错）和烯丙吗啡可用于吗啡中毒解救。